食品中菌落总数是食品的什么标志
A. 酸败程度
B. 腐败程度
C. 食品质量
D. 清洁状态
E. 生物性污染程度

正确答案：D。清洁状态